下列哪项不属于八纲辨证的内容
A. 病性寒热
B. 病变吉凶
C. 邪正盛衰
D. 病变类别
E. 病变部位

正确答案：B。病变吉凶

解析：八纲辨证的内容包括病情性质（寒和热）、邪正盛衰（虚和实）、病变类别（阴和阳）、病变部位（表和里）。病变凶吉不属于八纲辨证的内容，而选项A、C、D、E均为八纲辨证的内容（B对ACDE错）。